鼻旁窦位于
A. 腭骨、蝶骨、枕骨
B. 额骨、蝶骨、筛骨、颞骨
C. 额骨、蝶骨、筛骨、上颌骨
D. 上颌骨、下颌骨、筛骨
E. 蝶骨、额骨、颞骨、下颌骨

正确答案：C。额骨、蝶骨、筛骨、上颌骨

解析：鼻旁窦是上颌骨、额骨、蝶骨及筛骨内的骨腔，位于鼻腔周围并开口于鼻腔（C对）。